女，55岁。皮肤黄染进行性加重1个月，10天前发现小便呈浓茶样，近几天大便呈灰白色，查体：T36.8℃，皮肤巩膜黄染，腹软，右上腹可触及肿大的胆囊，无压痛，无反跳痛。该病人手术治疗后第4天发生上腹剧烈疼痛，腹腔引流量明显增加，引流液淀粉酶15000U/L。病人最有可能发生的并发症是
A. 胰瘘
B. 急性胰腺炎
C. 肠系膜血栓形成
D. 肠瘘
E. 胆瘘

正确答案：A。胰瘘

解析：中年女性患者，进行性黄疸1个月，大便呈灰白色（提示胆道完全梗阻），查体见皮肤巩膜黄染，胆囊肿大，无压痛、反跳痛（Courvoisier征，提示胰头癌），结合患者病史、体查，应考虑为胰头癌。胰头癌常用的手术方式为胰头十二指肠切除术（Whipple手术），切除范围包括胰头、远端胃、十二指肠、上段空肠、胆囊和胆总管，术后易发生胰瘘、胆瘘、肠瘘。患者术后第4天发生上腹剧烈疼痛，腹腔引流量明显增加，引流液淀粉酶15000U/L，最可能的并发症是胰瘘（A对）。肠瘘（D错）或胆瘘（E错）时腹腔引流液可有淀粉酶升高，但多不明显。胰头十二指肠切除术后较少发生急性胰腺炎（B错）、肠系膜血栓形成（C错）等。